正常人两上肢血压的差别一般是
A. 5～10mmHg
B. 11～15mmHg
C. 16～20mmHg
D. 21～25mmHg
E. 26～30mmHg

正确答案：A。5～10mmHg

解析：正常人双侧上肢血压差别达5~10mmHg（A对BCDE错），若超出此范围则属异常，见于多发性大动脉炎或先天性动脉畸形等。